为增强固肠止泻作用，宜选面裹煨的药材是
A. 黄芪
B. 肉豆蔻
C. 槟榔
D. 葛根
E. 丹参

正确答案：B。肉豆蔻

解析：本题考查的是肉豆蔻的常用炮制方法。为增强固肠止泻作用，宜选面裹煨的药材是肉豆蔻（B对）。肉豆蔻：【炮制作用】肉豆蔻味辛，性温。归脾、胃、大肠经。具有涩肠止泻、温中行气、开胃消食的功能。①生肉豆蔻辛温气香，长于暖胃消食，下气止呕。但生肉豆蔻含有大量油质，有滑肠之弊，并具刺激性，一般多制用。②煨肉豆蔻可除去部分油质，免于滑肠，刺激性减小，增强了固肠止泻的功能。用于心腹胀痛，虚弱冷痢，呕吐，宿食不消。黄芪（A错）：【炮制作用】黄芪味甘，性温。归肺、脾经。具有补气固表，利尿托毒，排脓，敛疮生肌的功能。①生品长于益卫固表，托毒生肌，利尿退肿。常用于表卫不固的自汗或体虚易于感冒，气虚水肿，痈疽不溃或溃久不敛。②炙黄芪甘温而偏润，长于益气补中。多用于脾肺气虚，食少便溏，气短乏力或兼中气下陷之久泻脱肛、子宫下垂以及气虚不能摄血的便血、崩漏等出血症；也可用于气虚便秘。槟榔（C错）：【炮制作用】槟榔味苦、辛，性温。归胃、大肠经。具有杀虫，消积，降气，行水，截虐的功效。①生槟榔力峻，杀虫破积、降气行水、截疟力胜。用于绦虫，姜片虫，蛔虫及水肿，脚气，疟疾。②槟榔炒后可缓和药性，以免克伐太过而耗伤正气，并能减少服后恶心、腹泻、腹痛的副作用。③焦槟榔和炒槟榔作用相似，长于消食导滞。用于食积不消，泻痢后重。但炒槟榔较焦槟榔作用稍强，而克伐正气的作用也略强于焦槟榔，一般身体素质稍强者可选用炒槟榔，身体素质较差者可选用焦槟榔。葛根（D错）用煨法炮制，可缓和药性。丹参（E错）：【炮制作用】丹参味苦，性微寒。归心、肝经。临床多生用。具有祛瘀止痛，清心除烦，通血脉的功能。善调妇女经脉不匀，因其性偏寒凉，故多用于血热瘀滞所致的疮痈，产后瘀滞疼痛，经闭腹痛，心腹疼痛及肢体疼痛。酒丹参，寒凉之性缓和，活血祛瘀、调经止痛功能增强。多用于月经不调，血滞经闭，恶露不下，心胸疼痛，癥瘕积聚，风湿痹痛。